所谓得气，体现的经络功能是
A. 沟通经络作用
B. 运输渗灌作用
C. 感应传导作用
D. 调节平衡作用
E. 运行气血作用

正确答案：C。感应传导作用

解析：感应传导，是指经络系统具有感应及传导针灸或其他刺激等各种信息的作用。得气就是对于经穴刺激所引起的感应和传导（C对）。沟通经络作用主要体现在脏腑与体表、官窍的联系，以及脏腑之间、经络之间的联系（A错）。经络运输渗灌气血的作用，体现为经脉作为运行气血的主要通道而具有运输气血的作 用，以及络脉作为经脉的分支而具有布散和渗灌经脉气血到脏腑形体官窍及经络自身的作用（B错）。调解平衡作用是经络系统通过其沟通联系、运输渗灌气血作用及其经气的感受和负载信息的作用，对各 脏腑形体官窍的机能活动进行调节，使人体复杂的生理机能相互协调，维持阴阳动态平衡状 态（D错）。运行气血的作用与运输渗灌作用相同（E错）。